霍乱患者临床最常见的症状是
A. 畏寒、发热
B. 剧烈吐泻
C. 严重腹泻
D. 腓肠肌痉挛
E. 腹痛、里急后重

正确答案：B。剧烈吐泻